男性30岁，由5m高处跌下2小时。腹痛，腹肌紧张，有压痛和反跳痛，肠鸣音弱。血压104/70mmHg，脉率120次/min。血红蛋白80g/L。X线检查：右侧第9、10肋骨骨折，右侧膈肌升高。最可能的诊断是
A. 肝破裂
B. 胃破裂
C. 脾破裂
D. 横结肠破裂
E. 胰腺断裂

正确答案：A。肝破裂

解析：青年男性患者，高处坠落后，腹部压痛、反跳痛，腹肌紧张（腹膜刺激症状），脉率120次/min（正常值为60～100次/分），血红蛋白80g/L（男性正常值为120～160g/L），两者提示腹腔内出血，X线检查：右侧第9、10肋骨骨折，右侧膈肌升高（提示肝脏破裂出血），结合患者病史、体查、实验室和影像学检查，应诊断为肝破裂（A对）；右侧第9、10肋骨骨折。胃破裂（B错）主要表现为明显的腹膜刺激症状，出血量较少，X线检查可见膈下游离气体。脾破裂（C错）时腹膜刺激症状多不明显，而血压下降等失血症状突出；结肠破裂（D错）多表现为较晚出现的腹膜刺激症状；胰腺断裂（E错）可出现明显的腹痛、腹膜刺激征以及失血症状，上述三者X线检查均不会出现右侧膈肌升高的表现。